Th1细胞通过产生IFN-γ，激活巨噬细胞发动
A. Ⅰ型超敏反应
B. Ⅱ型超敏反应
C. Ⅲ型超敏反应
D. Ⅳ型超敏反应
E. Ⅴ型超敏反应

正确答案：D。Ⅳ型超敏反应

解析：Th1细胞通过产生IFN-γ，激活巨噬细胞发动Ⅳ型超敏反应。掌握“B细胞、T细胞介导的免疫应答”知识点。